食物是引起龋病的因素以下观点哪项是错误的
A. 食物在牙面滞留会引起龋
B. 吃糖量比吃糖次数对于龋的发生更重要
C. 食物磷含量与龋发生有关
D. 食物物理性状与龋病发生密切相关
E. 蔗糖必须通过细菌作用才能致龋

正确答案：B。吃糖量比吃糖次数对于龋的发生更重要

解析：本题考查龋病发生的食物因素-碳水化合物。吃糖次数多会对牙面的细菌持续提供代谢繁殖的原料，吃糖量多只是暂时提供代谢原料，细菌致龋需要一定的时间，所以吃糖次数比吃糖量对于龋的发生更重要（B错，为本题的正确答案）。食物在牙面滞留会引起龋（A对），因为食物是菌斑致病的原料和代谢基础。食物磷含量与龋发生有关（C对），因为磷能促进牙齿的钙化，增强牙齿的抗龋力。食物物理性状与龋病发生密切相关（D对），粘稠而精细的食物易于黏附于牙齿表面，增加牙齿的患龋风险；粗制食物不易黏附于牙面，且对牙面有清洁作用，有一定的抗龋能力。蔗糖必须通过细菌作用才能致龋（E对），因为细菌是龋病的始动因子，蔗糖只有在细菌的代谢下才能产酸致龋。